首选用于治疗肺炎球菌肺炎的抗生素是
A. 四环素
B. 红霉素
C. 青霉素
D. 氯霉素
E. 卡那霉素

正确答案：C。青霉素

解析：青霉素（C对）属于β内酰胺类抗生素，抗菌作用强，在细菌繁殖期低浓度抑菌，较高浓度杀菌，对大多数革兰阳性球菌如肺炎球菌、溶血性链球菌、草绿色链球菌、敏感的金黄色葡萄球菌等具有较高抗菌活性，为治疗肺炎球菌肺炎的首选药。四环素（A错）属于快速抑菌剂，高浓度具有杀菌作用，临床主要用于立克次体感染支原体属感染、衣原体属感染，还可首选用于鼠疫、霍乱、布鲁菌病、幽门螺旋杆菌感染引起的消化性溃疡、肉芽肿鞘杆菌感染引起的腹股沟肉芽肿。红霉素（B错）主要用于对青霉素过敏的金黄色葡萄球菌，对军团菌、弯曲杆菌、支原体肺炎、沙眼衣原体所致的婴儿肺炎和结膜炎可作为首选药。氯霉素（D错）对造血系统具有毒性，一般不作为首选药物，可用于伤寒、立克次体感染、流感嗜血杆菌感染等。卡那霉素（E错）抗菌谱与链霉素相似，对结核杆菌作用稍强。